先将乳化剂分散于油中，再将水加入，乳化使成初乳的方法属于
A. 干胶法
B. 湿胶法
C. 两相交替加入法
D. 新生皂法
E. 机械法

正确答案：A。干胶法